（牙合）面盒形洞，一般应深入牙本质内
A. 0.2～0.5mm
B. 0.5～1mm
C. 1.0～1.5mm
D. 1.5～2.0mm

正确答案：A。0.2～0.5mm

解析：本题考查抗力形-洞深。盒形洞是窝洞最基本的抗力形，必须要求盒形洞有一定的深度，使充填体有足够厚度，一般洞深要求应深入牙本质内0.2～0.5mm（A对），不要过深如达到0.5～1mm（B错）可能会穿髓。邻面洞，釉质较薄，且承受咬合力小，洞深较浅为1.0～1.5mm（C错）。（牙合）面洞，釉质较厚，且承受咬合力大，洞的总深度应为1.5～2.0mm（D错）。